萎缩性胃窦胃炎患者表现为
A. 胃酸明显减少
B. 胃酸明显增高
C. 胃酸轻度升高
D. 胃酸轻度减少
E. 胃酸正常或减少

正确答案：E。胃酸正常或减少

解析：萎缩性胃窦胃炎为B型胃炎，分泌盐酸和内因子的壁细胞主要分布在胃底和胃体，萎缩性胃窦胃炎患者表现为胃酸正常或减少（E对）。胃酸明显减小（A错）见于重度胃体萎缩型胃炎（A型胃炎）：壁细胞位于胃体，胃体重度萎缩时壁细胞分泌胃酸明显受到抑制。胃酸明显增高（B错）见于胃泌素瘤：胃泌素瘤分泌大量胃泌素可刺激壁细胞增生，分泌大量胃酸。胃酸轻度升高（C错）见于十二指肠溃疡。